我国新时期卫生工作方针的战略重点是
A. 农村卫生
B. 依靠科技与教育
C. 为人民健康服务
D. 动员全社会参与
E. 农村卫生、预防保健和中医药

正确答案：E。农村卫生、预防保健和中医药